幽门梗阻病人呕吐10天，血压90/75mmHg，血钾3.1mmol/L，pH值7.5，应诊断为
A. 呼吸性酸中毒
B. 呼吸性碱中毒
C. 代谢性酸中毒
D. 代谢性碱中毒
E. 代谢性酸中毒合并呼吸性酸中毒

正确答案：D。代谢性碱中毒

解析：幽门梗阻病人呕吐10天，大量胃液丢失，该患者pH值7.5（正常值7.35～7.45），血钾3.1mmol/L（正常值3.5～5.5mmol/L），故该患者应诊断为低钾性代谢性碱中毒（D对）。患者并没有呼吸系统问题，不会出现呼酸或呼碱（ABE错）。代谢性酸中毒（C错）pH值＜7.35，多由于酸性物质产生过多或HCO₃⁻丢失过多而引起。